女性，30岁，3个月来工作较累，近3周出现兴趣缺乏，易疲劳，言语少，动作迟缓，自觉脑子笨，没有以前聪明，早醒，食欲减退，腹胀，便秘，全身酸痛，有时感心慌气紧。总觉自己患了不治之症，给家庭带来许多麻烦。你认为该病人最可能的诊断是
A. 焦虑症
B. 神经衰弱
C. 疑病症
D. 抑郁症
E. 心身疾病

正确答案：D。抑郁症

解析：患者有3个月工作劳累的诱因，核心症状表现为兴趣缺失、经历减退，心理症状群有动作迟缓、注意力和记忆力下降（自觉脑子笨，没有以前聪明）、自知力受损（总觉自己患了不治之症），躯体症状群有睡眠紊乱、食欲紊乱和胃肠功能紊乱、慢性疼痛、心慌气短，因而患者的症状体征符合抑郁症诊断，最可能是抑郁症（D对）。焦虑症（A错）主要表现为出现与现实情境不符的过分担心、紧张害怕，伴胸闷、心慌、呼吸困难、出汗、全身发抖等。神经衰弱（B错）主要表现为持续和令人苦恼的脑力易疲劳（如感到没有精神，自感脑子迟钝，注意力不集中或不持久，记忆力差，思考效率下降）和体力易疲劳，经过休息或娱乐不能恢复。疑病症（C错）主要表现为患者担心或相信患有一种或多种严重躯体疾病，反复就医，尽管经反复医学检查显示阴性以及医生给予没有相应疾病的医学解释也不能打消病人的顾虑，常伴有焦虑或抑郁。心身疾病（E错）是心理社会因素在疾病的发生、发展过程中起重要作用的躯体器质性疾病和躯体功能性障碍。